肾病综合征时，导致组织水肿的原因是
A. 毛细血管血压升高
B. 血浆胶体渗透压降低
C. 组织液胶体渗透压增高
D. 淋巴回流受阻
E. 毛细血管壁通透性增加

正确答案：B。血浆胶体渗透压降低